肾综合征出血热的防御措施是
A. 灭虱
B. 灭鼠
C. 灭蜱
D. 灭蚤
E. 灭蚊

正确答案：B。灭鼠

解析：肾综合征出血热的防御措施是灭鼠（B对），肾综合征出血热是由汉坦病毒属的各种病毒引起的，汉坦病毒主要宿主动物为啮齿类，在我国以鼠类为主，鼠类携带病毒的排泄物形成的气溶胶、污染的食物及带病毒鼠类的直接咬伤等均可感染人体，一般认为灭鼠后Ⅱ型病毒的发病率能较好的控制和下降。灭虱（A错）是流行性斑疹伤寒的防御措施（P138）。灭蚤（D错）灭鼠是地方性斑疹伤寒的防御措施（P140）。灭蜱（D错）是人无形体病的防御措施（P145）。灭蚊（E错）是流行性乙型脑炎的防御措施（P92）。